严重肝功能不全患者应避免选用的抗菌药物有
A. 米诺环素
B. 头孢唑林
C. 阿奇霉素
D. 庆大霉素
E. 头孢他啶

正确答案：A、C、D。米诺环素；阿奇霉素；庆大霉素

解析：本题考查特殊人群用药。严重肝功能不全患者应避免选用的抗菌药物有米诺环素（A对）、阿奇霉素（C对）、庆大霉素（D对）。米诺环素：肝、肾功能不全、食道通过障碍者、老年人、口服吸收不良或不能进食者及全身状态恶化患者（因易引发维生素K缺乏症）慎用。阿奇霉素：对阿奇霉素、红霉素、其他大环内酯类或酮内酯类药物过敏的患者禁用，以前使用阿奇霉素后有胆汁淤积性黄疸/肝功能不全病史的患者禁用。庆大霉素：对于肾功能不全者或长期用药者应进行药物监测。